青光眼患者忌服的药是
A. 砒霜
B. 天仙子
C. 闹羊花
D. 白降丹
E. 生狼毒

正确答案：B。天仙子

解析：本题考查的是天仙子的注意事项。青光眼患者忌服的药是天仙子（B对）。生天仙子的用法用量：内服，0.06～0.6g。注意事项：心脏病、心动过速、青光眼患者及孕妇禁用。砒霜（A错）为砒石的毒性成分。砒石（红砒，白砒）的用法用量：内服0.002～0.004g，入丸散外用适量，研末撒、调敷或入膏药中贴之。注意事项：毒性大，用时宜慎；不宜与水银同用；体虚及孕妇忌服。闹羊花（C错）的用法用量：内服0.6～1.5g，浸酒或入丸散。外用适量，煎水洗。注意事项：不宜多服、久服。体虚者及孕妇禁用。白降丹（D错）的用法用量：外用适量，研末调敷或作药捻。注意事项：不可内服，具腐蚀性。生狼毒（E错）的用法用量：熬膏外敷。注意事项：不宜与密陀僧同用。